战争年代因饥荒、人口拥挤、人口流动性增大而引起的急慢性传染病流行属于
A. 在流行病学三角模型中，环境因素不变，病因比重增加
B. 宿主因素发生变化，宿主比重增加
C. 病因、宿主、环境三要素保持动态平衡
D. 环境因素发生变化，导致病因比重增加
E. 环境因素发生变化，导致宿主比重增加

正确答案：E。环境因素发生变化，导致宿主比重增加